根据《麻醉药品和精神药品管理条例》，定点批发企业销售超过有效期的麻醉药品和精神药品的
A. 由药品监督管理部门取消其定点批发资格，并依照药品管理法的有关规定处罚
B. 由药品监督管理部门责令改正，给予警告，没收违法交易的药品，并处罚款
C. 由设区的市级人民政府卫生主管部门责令限期改正，给予警告
D. 由县级以上人民政府卫生主管部门给予警告，暂停其执业活动
E. 由药品监督管理部门责令限期改正，给予警告

正确答案：A。由药品监督管理部门取消其定点批发资格，并依照药品管理法的有关规定处罚

解析：本题考查违反麻醉药品和精神药品管理规定的法律责任。根据《麻醉药品和精神药品管理条例》，定点批发企业销售超过有效期的麻醉药品和精神药品的由药品监督管理部门取消其定点批发资格，并依照药品管理法的有关规定处罚（A对）。劣药的界定：根据《药品管理法》第九十八条第三款规定，有下列情形之一的，为劣药：①药品成分的含量不符合国家药品标准；②被污染的药品；③未标明或者更改有效期的药品；④未注明或者更改产品批号的药品；⑤超过有效期的药品；⑥擅自添加防腐剂、辅料的药品；⑦其他不符合药品标准的药品。《麻醉药品和精神药品管理条例》第八章法律责任第七十八条：定点生产企业、定点批发企业和第二类精神药品零售企业生产、销售假劣麻醉药品和精神药品的，由药品监督管理部门取消其定点生产资格、定点批发资格或者第二类精神药品零售资格，并依照药品管理法的有关规定予以处罚。